与苯乙肼同用会出现高血压危象和脑出血的是
A. 各种白酒
B. 乳酪食品
C. 葡萄柚汁
D. 盐腌海鱼
E. 茶叶

正确答案：B。乳酪食品

解析：本题考查苯乙肼的使用。苯乙肼会引起肝实质损害，且与富含酪胺的食物（奶酪（B对）、酵母、鸡肝、酒类等）合用时可发生高血压危象。酒（A错）的主要成分为乙醇，能够扩张血管，刺激或抑制肝药酶代谢系统。葡萄柚汁（C错）主要影响CYP3A4代谢，同时可抑制CYP3A4的活性。盐腌海鱼（D错）属于高蛋白食物，服用抗拮抗药异烟肼时，不宜与异烟肼同服。茶叶（E错）中含有大量的鞣酸，鞣酸能与药中的多种金属离子结合而发生沉淀，影响药品吸收。